下列各项，适于采取"补法"的是
A. 蜂窝织炎中期，热毒炽盛
B. 初期肿疡
C. 溃疡后期，疮口难敛
D. 蜂窝织炎已成脓
E. 溃疡早期

正确答案：C。溃疡后期，疮口难敛

解析：补法适用于溃疡后期，此时毒势已去，精神衰疲，气血虚弱，脓水清稀，肉芽灰白不实，疮口难敛（C对）。消法适用于尚未成脓的初期肿疡（B、E错）和非化脓性肿块性疾病及各种皮肤疾病。托法适用于外疡中期（A错）即成脓期（D错）。